颊舌侧牙龈乳头高度不一致
A. 悬吊缝合
B. 冠向复位缝合
C. 锚式缝合
D. 水平褥式缝合
E. 牙间间断缝合

正确答案：A。悬吊缝合

解析：本题考查龈瓣缝合的方法。悬吊缝合（A对）适用于颊舌侧牙龈乳头高度不一致时。悬吊缝合是利用术区的牙齿来悬吊固定龈瓣。牙间间断缝合（E错）是在牙齿邻间隙处，将颊、舌侧龈乳头瓣直接拉拢缝合，适用于唇、舌两侧龈瓣的张力相等、高低一致时。水平褥式缝合（D错）适用于两牙之间有较大缝隙或龈乳头较宽时，能使龈瓣能更好地贴合骨面。锚式缝合（C错）适用于最后一个磨牙远中楔形瓣的缝合，或与缺牙间隙相邻处的龈瓣闭合，是将最后一个磨牙远中的龈瓣或缺牙间隙处的龈瓣以锚样的方式固定在邻近的牙上。冠向复位缝合（B错）适用于牙周再生术或前牙区的牙冠增长术，是要将瓣缝合后往冠向固定。